肺结核阴阳两虚宜选用
A. 百合固金汤
B. 月华丸
C. 保真汤加减
D. 补天大造丸加减
E. 沙参麦门冬汤

正确答案：D。补天大造丸加减

解析：肺结核阴阳两虚证，治宜滋阴补阳，宜用补五脏虚劳的补天大造丸（D对）。百合固金汤滋润肺肾，止咳化痰，主治肺肾阴亏，虚火上炎证，是肺结核阴虚火旺证的代表方（A错）。月华丸滋阴润肺，是肺结核肺阴亏虚证的代表方（B错）。保真汤益气养阴，主治肺结核气阴两虚证（C错）。沙参麦冬汤功用滋养肺胃，降逆下气，主治虚热肺痿胃阴不足证（E错）。